对原发性肝癌早期诊断最有价值的是
A. 甲胎蛋白测定
B. 癌胚抗原测定
C. B超检查
D. CT检查
E. 腹部平片

正确答案：A。甲胎蛋白测定

解析：甲胎蛋白是在胎儿早期由肝脏和卵黄囊合成的一种血清糖蛋白，出生后，AFP的合成很快受到抑制。当肝细胞或生殖腺胚胎组织发生恶性病变时，有关基因重新被激活，使原来丧失合成AFP的细胞又重新开始合成，以致血中AFP含量明显升高。甲胎蛋白测定（A对）是诊断肝细胞癌特异性的标志物，阳性率可达70％，是目前临床上对原发性肝癌早期诊断最有价值的指标。癌胚抗原（B错）是一种广谱性肿瘤标志物，特异性不高。B超检查（C错）和CT检查（D错）对于原发性肝癌的早期诊断敏感性不高，只有当其发展到一定程度才能被发现。腹部平片（E错）主要用于肠道积气、穿孔、肿瘤等疾病的诊断，对原发性肝癌早期诊断的价值有限。